选择性抑制COX-2的药物是
A. 阿司匹林
B. 塞来昔布
C. 对乙酰氨基酚
D. 布洛芬
E. 保泰松

正确答案：B。塞来昔布

解析：塞来昔布选择性抑制COX-2，在治疗剂量时对人体内COX-1无明显影响，也不影响TXA2的合成（B对）。